肠切除术后肠瘘长期禁食患者可能出现的凝血因子异常是
A. 缺少凝血因子Ⅲ和Ⅹ
B. 缺少凝血因子Ⅲ和Ⅴ
C. 缺少凝血因子Ⅱ和Ⅹ
D. 缺少凝血因子Ⅷ和Ⅸ
E. 缺少凝血因子Ⅳ和Ⅶ

正确答案：C。缺少凝血因子Ⅱ和Ⅹ

解析：肠切除术后肠瘘长期禁食患者由于富含维生素K的食物摄入缺乏、肠黏膜吸收面积减少、肠道菌群的丢失或改变，导致体内维生素K的缺乏，依赖维生素K的凝血因子合成障碍可出现.缺少凝血因子Ⅱ和Ⅹ（C对）、Ⅶ、Ⅸ等异常。缺少凝血因子Ⅷ和Ⅸ（D错）为血友病可出现的凝血因子异常。